女性，45岁，已经明确诊断为慢性牙周炎并经基础治疗4月后，牙周袋探诊深度仍然为6mm，且探诊后出血，则该患者最适宜做
A. 袋内壁刮治术
B. 翻瓣术
C. 隧道成形术
D. 截根术
E. 引导性组织再生术

正确答案：B。翻瓣术

解析：本题考查翻瓣术的适应症。患者女，45岁，已经明确诊断为慢性牙周炎并经基础治疗4月后（超过12周），牙周袋探诊深度仍然为6mm（＞5mm），且探诊后出血（根面牙石），则该患者最适宜做翻瓣术（B对）。翻瓣术可在直视下彻底刮除根面或根分叉处的牙石及不健康的肉芽组织，修整牙龈和牙槽骨的外形，植骨，或截除病情严重的患根等，通过手术改正牙周软硬组织的外形，形成一种有利于患者控制菌斑的生理外形。袋内壁刮治术（A错）是用手术方法刮治并彻底清除袋壁病变组织，使血块充满伤口，待血块机化后，达到组织再附着的一种牙周手术，适应于范围比较局限的骨上袋和骨下袋，尤以袋内周围存在牙槽骨壁者效果较好。隧道成形术（C错）是在牙根之间的根分叉处创造一个便于清洁的区域，以便使用常规的牙菌斑控制方式进行清洁，从而减少细菌对牙周组织的破坏以及这些位点的复发风险。截根术（D错）又称牙根切除术，当多根牙的某一个根患有难以治愈的深牙周袋和骨吸收，或重度根分叉病变时，可将该患根切除，保留其余可保存的牙根及牙冠，以延长该牙的寿命。引导性组织再生术（E错）是用外科的方法放置一个物理屏障来选择性地分隔不同的牙周组织，阻止牙龈上皮和牙龈结缔组织向根面生长造成空间，诱导具有牙周组织再生潜力的牙周膜细胞冠向移动并生长分化，实现牙周膜、牙槽骨、牙骨质再生，形成牙周新附着。